影响化学物质经呼吸道吸收的因素是
A. 肺泡的通气量与血流量之比
B. 溶解度
C. 气血分配系数
D. 以上都是

正确答案：D。以上都是

解析：本题考查影响化学物质经呼吸道吸收的因素。影响化学物质经呼吸道吸收的因素是：肺泡的通气量与血流量之比；溶解度；血气分配系数（D对ABC错）；化学物质的分子量。